女，45岁。体检发现右乳肿块，直径2cm，活动度差，边界不清。术后病理可见乳腺间质中有串珠样单行癌细胞排列。最可能的诊断是
A. 导管原位癌
B. 小叶原位癌
C. 小叶浸润癌
D. 髓样癌
E. 导管侵润癌

正确答案：C。小叶浸润癌

解析：患者中年女性，体检发现右乳肿块，直径2cm，活动度差，边界不清（恶性肿块）。诊断为乳腺癌。术后病理可见乳腺间质中有串珠样单行癌细胞排列，诊断为小叶浸润癌（C对）。导管原位癌（A错）导管扩张明显，癌细胞局限于导管内，导管基膜完整。小叶原位癌（B错）多累及双侧乳腺，常为多中心性，局限在小叶的末梢导管和腺泡。髓样癌（D错）癌细胞巢之间间质较少，肿瘤周围有明显的淋巴细胞浸润。导管浸润癌（E错）癌细胞排列成巢状，团索状，在纤维间质中浸润生长。